女，45岁。反复发作进食油腻食物后右上腹疼痛2年，影响生活。近半年控制饮食后发作次数减少，最近一次发作是3个月前。超声检查发现胆囊结石，胆囊缩小，囊壁增厚，粗糙。该患者首选的治疗方法是
A. 胆囊造影术
B. 体外碎石
C. 胆肠吻合术
D. 口服消炎利胆药物
E. 胆囊切除术

正确答案：E。胆囊切除术

解析：中年女性患者，反复右上腹疼痛，超声检查发现胆囊结石，胆囊缩小，囊壁增厚，粗糙，应诊断为胆囊结石合并慢性胆囊炎，符合手术的指征，所以应首选胆囊切除术（E对）。